属于二磷酸腺苷P2Y12受体阻断剂的是
A. 阿司匹林
B. 氯吡格雷
C. 替罗非班
D. 奥扎格雷钠
E. 前列环素

正确答案：B。氯吡格雷

解析：本题考查二磷酸腺苷P2Y12受体阻断剂。氯吡格雷（B对）为二磷酸腺苷P2Y12受体阻断剂，可抑制血小板聚集而不影响ADP介导的血管反应。阿司匹林（A错）为环氧酶抑制剂。替罗非班（C错）为高选择性非肽类血小板膜糖蛋白Ⅱb/Ⅲa受体阻断剂。奥扎格雷钠（D错）为血栓烷合成酶抑制剂。前列环素（E错）为血小板腺苷环化酶刺激剂。